磺胺类药物抗菌机制是抑制细菌体内哪种物质的合成
A. 二氢叶酸
B. 四氢叶酸
C. 核糖核酸
D. 碳水化合物
E. 蛋白质

正确答案：A。二氢叶酸

解析：对磺胺药敏感的细菌，在生长繁殖过程中不能利用现成的叶酸，而磺胺药可阻止细菌二氢叶酸合成，从而发挥抑菌作用。掌握“磺胺类及甲硝唑”知识点。